Addison病的体征是
A. 苦笑面容
B. 满月脸
C. 面色苍白
D. 毛发旺盛
E. 色素沉着

正确答案：E。色素沉着

解析：Addison病最具特征性者为全身皮肤色素加深（E对），是原发性肾上腺皮质功能减退，负反馈致垂体ACTH、黑素细胞雌激素分泌增多所致。苦笑面容（A错）见于破伤风。满月脸（B错）见于库欣综合征及长期应用糖皮质激素者。面色苍白（C错）见于腺垂体功能减退者，是垂体ACTH、黑素细胞刺激素分泌减少所致。